患者，男，60岁，上颌总义齿纵折，主诉修复两年来，纵折三次，检查患者牙槽嵴尚可。下颌弓后部明显大于上颌弓，旧义齿为正常（牙合）排列，义齿固位良好，边缘伸展适宜。分析原因为
A. 基托过薄
B. 上颌人工牙排列过于偏颊侧
C. 咬（牙合）不平衡
D. 基托为塑料基托
E. 人工牙为瓷牙

正确答案：B。上颌人工牙排列过于偏颊侧

解析：该患者下颌牙弓明显大于上颌，旧义齿为了排列成正常（牙合），必须将两侧后牙排列在牙槽嵴顶的外侧，咬合时，以上颌硬区形成支点，两侧后牙区受到向上的（牙合）力，中间的部分受到上颌硬区向下的支持力，久之即造成义齿的折断。掌握“全口义齿排牙及蜡型试戴”知识点。